肺炎喘嗽的主要病机是
A. 肺失宣肃
B. 风热犯肺
C. 肺气郁闭
D. 外邪犯肺
E. 痰热蕴肺

正确答案：C。肺气郁闭

解析：肺炎喘嗽的原因，主要有外因和内因两大类。外因责之于感受风邪，或由其他疾病传变而来；内因责之于小儿形气未充，肺脏娇嫩，卫外不固。肺为娇脏，肺主气，司呼吸，外合皮毛，开窍于鼻。外感风邪，由口鼻或皮毛而入，侵犯肺卫，致肺气郁闭，肺失宣降，闭郁不宣，化热灼津炼液成痰，阻于气道，肃降无权，从而出现咳嗽、气喘、痰鸣、鼻煽等肺气闭塞的证候，发为肺炎喘嗽，故其病机关键为肺气郁闭（C对）。肺失宣肃（A错）为急性支气管炎的主要病机。风热犯肺（B错）可为风热咳嗽、风热感冒的病机。外邪犯肺（D错）可为外感咳嗽或肺炎喘嗽的病因之一。痰热蕴肺（E错）可为外感咳嗽或哮喘的病因之一。